某电焊辅助工，与师傅工作4小时后，突然感到眼发干、异物感，并肿胀而被送医院就诊。此工人可能患何种疾病
A. 眼损伤
B. 眼外伤
C. 电光性眼炎
D. 眼炎
E. 结膜炎

正确答案：C。电光性眼炎

解析：本题考查电光性眼炎的症状。电光性眼炎（C对ABDE错）是指角膜和结膜上皮大量吸收波长为250～320㎚的紫外线，从而引起的急性角膜结膜炎。多见于电焊作业人员和焊接辅助作业人员。轻症电光性眼炎表现为双眼异物感、轻度畏光不适；重度则有眼部烧灼感或剧痛，伴有高度畏光、流泪和视物模糊。本题中电焊辅助工职业史和症状符合电光性眼炎的条件，诊断为电光性眼炎。